属于感觉性神经节的是
A. 脊神经节、椎旁神经节、三叉神经节、前庭神经节
B. 三叉神经节、膝神经节、腹腔神经节、前庭神经节
C. 脊神经节、三叉神经节、膝神经节、前庭神经节
D. 上神经节、耳神经节、肠系膜上神经节、前庭神经节
E. 睫状神经节、翼腭神经节、下神经节、前庭神经节

正确答案：C。脊神经节、三叉神经节、膝神经节、前庭神经节

解析：脊神经后根在椎间孔处有椭圆形的膨大，称脊神经节，其中含有假单极感觉神经元。三叉神经节由假单极神经元胞体组成，其中枢突集中成粗大的三叉神经感觉根。特殊内脏感觉纤维的神经元胞体位于膝神经节。前庭神经节由双极感觉神经元组成（C对）。